无尿是指成人24小时尿量不足
A. 150ml
B. 100ml
C. 80ml
D. 50ml
E. 10ml

正确答案：B。100ml

解析：无尿是指成人24小时尿量不足100ml(B对)。